甘草的主要有效成分是
A. 木脂素类
B. 香豆素苷
C. 三萜皂苷类
D. 甾体皂苷类
E. 环烯醚萜苷类

正确答案：C。三萜皂苷类

解析：本题考查的是甘草的化学成分。甘草的主要有效成分是三萜皂苷类（C对）。甘草所含的三萜皂苷以甘草皂苷含量最高。甘草皂苷又称甘草酸，为甘草中的甜味成分。《中国药典》以甘草苷和甘草酸为指标成分，控制甘草和炙甘草的质量，其中甘草苷为黄酮苷，并要求甘草和炙甘草的甘草苷含量均不得少于0.50%，甘草中甘草酸的含量不得少于2.0%，炙甘草中甘草酸的含量不得少于1.0%。木脂素类（A错）多数是游离的，也有少量与糖结合成苷而存在，由于较广泛地存在于植物的木部和树脂中，或开始析出时呈树脂状，故称木脂素。主要有五味子醇、五味子素、厚朴酚、和厚朴酚、连翘苷等。含木脂素类化合物的常用中药有五味子、厚朴、连翘、细辛等。香豆素苷（B错）是邻羟基桂皮酸的内酯，广泛分布于高等植物中，尤其以芸香科和伞形科为多见，少数发现于动物和微生物中。含香豆素的常用中药有秦皮、前胡、肿节风、补骨脂等。在植物体内，它们往往以游离状态或与糖结合成苷的形式存在。甾体皂苷类（D错）与三萜皂苷相似，由甾体皂苷元与糖组成。含甾体皂苷的常用中药主要有麦冬、知母等。环烯醚萜苷类（E错）的数目较多，根据C-4位取代基的有无，又分为C-4位有取代基的环烯醚萜苷及4-去甲基环烯醚萜苷两种类型。①C-4位有取代基的环烯醚萜苷：C-4位取代基多为甲基或羧基、羧酸甲酯、羟甲基。如栀子中的栀子苷、京尼平苷、京尼平苷酸，鸡屎藤中的鸡屎藤苷。②4-去甲基环烯醚萜苷：环烯醚萜苷C-4位去甲基降解苷，苷元碳架部分由9个碳组成。如地黄中的梓醇、梓苷